按照《药品生产质量管理规范》规定，批生产记录应保存至药品有效期后
A. 1年
B. 2年
C. 3年
D. 4年
E. 5年

正确答案：A。1年